营养性缺铁性贫血的临床表现，错误的是
A. 年长儿可有头晕眼前发黑耳鸣等
B. 注意力不集中，记忆力减退
C. 食欲减退，可出现异食癖
D. 免疫功能低下，易合并感染
E. 年龄愈大，肝脾肿大越明显

正确答案：E。年龄愈大，肝脾肿大越明显

解析：营养性缺铁性贫血的临床表现有.1.一般表现：苍白（唇、口腔粘膜、甲床）、易疲乏、不爱活动。年长儿可诉头晕、眼前发黑、耳鸣等（A对）。2.髓外造血表现为年龄越小（E错，为本题正确答案），病程越久，贫血越重，肝脾肿大越明显。3.非造血系统症状有（1）消化系统症状：食欲减退，少数有异食癖等（C对）。（2）神经系统症状有精神不集中，记忆力减退，智力多低于同龄儿（B对）。（3）心血管系统症状：明显贫血时心率增快，心脏扩大，甚至心衰。（4）其他：因细胞免疫功能降低，常合并感染等（D对）。